具有神经内分泌功能的神经核是
A. 腹前核
B. 腹后内侧核
C. 视上核
D. 腹后外侧核
E. 无

正确答案：C。视上核

解析：具有神经内分泌功能的神经核是视上核（C对），能分泌ADH 和催产素；腹前核（A错）、腹后内侧核（B错）、腹后外侧核（D错）均不具有神经内分泌功能。